砂仁配木香除化湿理气外，又能
A. 调中止痛
B. 燥湿祛痰
C. 化湿解暑
D. 健脾安胎
E. 祛风除湿

正确答案：A。调中止痛

解析：本题考查砂仁的配伍。砂仁配木香除化湿理气外，又能调中止痛（A对）。砂仁【配伍】砂仁配木香：砂仁性温，功能化湿行气温中；木香性温，功能理气调中止痛。两药相配，化湿、理气、调中止痛力胜，凡湿滞、食积，或夹寒所致的脘腹胀痛皆可投用。兼脾虚者，又当配伍健脾之品。雄黄【功效】解毒，杀虫，燥湿祛痰（B错），截疟定惊。广藿香【配伍】广藿香配佩兰：广藿香微温，功能化湿和中、解暑、止呕，且兼发表；佩兰性平，功能化湿解暑。两药相配，尤善化湿和中、解暑（C错）、发表。凡湿浊中阻，无论兼寒兼热，也无论有无表证，均可投用。白术【功效】补气健脾，燥湿利水，止汗，安胎（D错）。川乌【功效】祛风除湿（E错），散寒止痛。